制备时一般不加崩解剂的片剂有
A. 分散片
B. 口含片
C. 舌下片
D. 泡腾片
E. 长效片

正确答案：B、C、E。口含片；舌下片；长效片